预防无菌切口感染的主要原则为
A. 皮下止血不用电烙
B. 血管结扎要用丝线
C. 严格无菌操作
D. 手术完毕用等渗盐水冲洗伤口
E. 切口放置引流物

正确答案：C。严格无菌操作

解析：预防无菌切口感染的主要原则为在实施操作时严格执行无菌观念。掌握“外科感染”知识点。